下列不按五行相生顺序排列的是
A. 呼、笑、歌、哭、呻
B. 青、赤、黄、白、黑
C. 角、商、宫、徵、羽
D. 筋、脉、肉、皮、骨
E. 酸、苦、甘、辛、咸

正确答案：C。角、商、宫、徵、羽

解析：五音的五行相生顺序：角，徵，宫，商，羽（C错，为本题正确答案）。五声的五行相生顺序：呼，笑，歌，哭，呻（A对）。五色的五行相生顺序：青，赤，黄，白，黑（B对）。形体的五行相生顺序：筋，脉，肉，皮毛，骨（D对）。五味的五行相生顺序：酸，苦，甘，辛，咸（E对）。